下面对于复发性阿弗他溃疡临床特点描述不正确的是
A. 溃疡表现为孤立的、圆形或椭圆形的浅表性溃疡
B. 病程一般为7～14天
C. 呈周期性复发且有自限性
D. 先出现密集分布的针头大小的小水疱，后破溃形成溃疡
E. 好发于中青年

正确答案：D。先出现密集分布的针头大小的小水疱，后破溃形成溃疡

解析：“先出现密集分布的针头大小的小水疱，后破溃形成溃疡”此为原发性单纯疱疹的特点。掌握“复发性阿弗他溃疡”知识点。